女，65岁。阵发性腹痛、腹胀、停止排气排便2天。既往有类似发作，程度较轻，未诊治。查体：P100次/分，BP110/70mmHg，双肺呼吸音清，未闻及干湿性啰音，心率100次/分，心律齐腹肌紧张，压痛明显，反跳痛阳性，移动性浊音阳性。最可能的诊断是
A. 不全性粘连性肠梗阻
B. 单纯性机械性肠梗阻
C. 绞窄性肠梗阻
D. 麻痹性肠梗阻
E. 完全性高位肠梗阻

正确答案：C。绞窄性肠梗阻

解析：女，65岁。阵发性腹痛、腹胀、停止排气排便2天。既往有类似发作，程度较轻，未诊治。查体：P100次/分（脉率增快），BP110/70mmHg（血压降低），双肺呼吸音清，未闻及干湿性啰音，心率100次/分，心律齐腹肌紧张，压痛明显，反跳痛阳性，移动性浊音阳性（腹膜炎表现）。根据病史、临床表现、辅助检查，患者有明显的腹膜刺激征表现，因此最可能的诊断是绞窄性肠梗阻（C对）。不全性粘连性肠梗阻（A错）、单纯性机械性肠梗阻（B错）可有腹痛、腹胀、停止排气排便等临床表现，但通常不会有腹膜刺激征及腹水。麻痹性肠梗阻（D错）的肠壁肌呈瘫痪状态，没有收缩蠕动 ， 因此无阵发性腹痛 ， 只有持续性胀痛或不适 ，听诊时肠鸣音减弱或消失。高位肠梗阻（E错）突出的临床表现为呕吐出现较早，呕吐较频繁，吐出物主要为胃及十二指肠内容 ，该患者无呕吐，高位肠梗阻可能性小，故暂不考虑。